临床使用时可引起神经肌肉麻痹
A. 青霉素
B. 链霉素
C. A和B均是
D. A和B均不是

正确答案：B。链霉素

解析：本题考查青霉素和链霉素的不良反应。链霉素（B对）与体液内的钙离子络合，使钙离子浓度降低，造成神经肌肉接头处传递阻断，产生神经和肌肉组织麻痹。青霉素（A错）不良反应为过敏反应，如过敏性休克（Ⅰ型变态反应）和血清病型反应（Ⅲ型变态反应）。